发病率指标来自
A. 对住院病人的调查
B. 对门诊病人的调查
C. 对社区人群的调查
D. 对所有病人的调查
E. 对专科医院病人的调查

正确答案：C。对社区人群的调查

解析：本题考查发病率指标的来源。发病率指标主要来自对社区人群的调查（C对ABDE错）。